分隔右心室流入道和流出道的结构是
A. 室上嵴
B. 肉柱
C. 三尖瓣
D. 冠状窦
E. 窦房结

正确答案：A。室上嵴

解析：室上嵴（A对）为分隔右心室流入道和流出道的结构，为一弓形的肌性隆起。